判断糖尿病的分型
A. 尿糖
B. 甲状腺素
C. 酮体
D. 糖化血红蛋白
E. C肽

正确答案：E。C肽

解析：C肽是胰岛β细胞的分泌产物，它与胰岛素有一个共同的前体-胰岛素原，理论上C肽和胰岛素是等同分泌的，且C肽的半衰期较胰岛素更长，故测定C肽水平能反应β细胞合成与释放胰岛素功能，而1型糖尿病和2型糖尿病的区别在于胰岛素分泌水平不一样，所以通过测定C肽水平能够给糖尿病分型（E对）。